具有脉位下沉特点的脉象是
A. 洪脉、革脉、濡脉
B. 芤脉、弱脉、虚脉
C. 洪脉、革脉、弱脉
D. 洪脉、濡脉、牢脉
E. 弱脉、伏脉、牢脉

正确答案：E。弱脉、伏脉、牢脉

解析：弱脉、伏脉、牢脉皆有脉位下沉的特点（E对）。洪脉有搏动部位浅表、指下有力的特点（ACD错）。芤脉有乳脉位偏浮、形大的特点（B错）。